男，57岁，1天前就餐时突然右上肢无力，不能握拳，20分钟后正常，反复3次，10-30分钟/次，过后缓解，BP：150/90mmHg，神经系统无阳性。诊断是
A. 短暂性脑缺血
B. 脑出血
C. 脑梗死
D. 蛛网膜下腔出血
E. 局灶癫痫发作

正确答案：A。短暂性脑缺血

解析：1天前就餐时突然右上肢无力，不能握拳，20分钟后正常，反复3次，每次10-30分钟缓解，BP：150/90mmHg，神经系统无阳性（符合TIA）。TIA临床表现：50-70岁，男性多见，不遗留后遗症。影像学无缺血征象（A对）。